螺内酯临床常用于治疗
A. 脑水肿
B. 急性肾功能衰竭
C. 醛固酮增高引起的水肿
D. 尿崩症
E. 高血压

正确答案：C。醛固酮增高引起的水肿

解析：本题考查螺内酯的临床作用。螺内酯临床常用于治疗醛固酮增高引起的水肿（C对）。螺内酯主要用于伴有醛固酮升高的顽固性水肿，如充血性心力衰竭、肝硬化腹水及肾病综合征。脑水肿（A错）、急性肾功能衰竭（B错）可选用呋塞米、甘露醇治疗。尿崩症（D错）、高血压（E错）选用噻嗪类利尿药进行治疗。